既温中止痛，又杀虫的药是
A. 花椒
B. 安息香
C. 小茴香
D. 草豆蔻
E. 沉香

正确答案：A。花椒